启脾丸不适用于那个病症
A. 湿热泄泻
B. 脾胃虚弱
C. 消化不良
D. 脾虚泄泻
E. 腹胀便溏

正确答案：A。湿热泄泻

解析：本题考查的是启脾丸的注意事项。启脾丸不适用于那个病症湿热泄泻（A对）。启脾丸（口服液）【主治】脾胃虚弱（B错），消化不良（C错），腹胀便溏（E错）。【注意事项】湿热泄泻者不宜使用。伴感冒发热、表证未解者慎用。服药期间，忌食生冷、油腻、不易消化食物。建立良好饮食习惯，防止偏食。